下列成分中，抗凝血作用最强的是
A. 水蛭素
B. 蚯蚓素
C. 蚯蚓毒素
D. 次黄嘌呤
E. 琥珀酸

正确答案：A。水蛭素